慢性吸入染毒试验的目的是
A. 求LC₅₀
B. 观察中毒症状
C. 找出最敏感指标
D. 研究有无蓄积作用
E. 确定阈浓度和阈下浓度

正确答案：E。确定阈浓度和阈下浓度

解析：本题考查慢性吸入染毒试验的目的。慢性吸入染毒试验是一种毒物暴露试验，其目的是确定毒物的阈浓度和阈下浓度（E对ABCD错）。阈浓度是指毒物的最大安全浓度，而阈下浓度是指毒物的最小安全浓度。